痈的气血两虚证，应首选的方剂是
A. 柴胡清肝汤
B. 五神汤合萆薢渗湿汤
C. 犀角地黄汤
D. 清瘟败毒饮
E. 十全大补汤

正确答案：E。十全大补汤

解析：十全大补汤温补气血，主治五劳七伤气血不足，所以气血两虚证，应首选的方剂是十全大补汤（E对）。柴胡清肝汤养血清火，疏肝散结，治疗肝脾湿火证（A错）。五神汤合萆薢渗湿汤利湿清热解毒，治疗湿热毒蕴证（B错）。犀角地黄汤凉血清热解毒，治疗胎火蕴毒证（C错）。清瘟败毒饮凉血解毒，治疗毒邪内攻证（D错）。